正常足月儿生后母乳喂养开奶时间是
A. 出生后15分钟～2小时
B. 出生后立即开奶
C. 出生后10分钟之内
D. 出生后0.5小时～5小时
E. 出生后2～3小时

正确答案：A。出生后15分钟～2小时

解析：目前主张尽早开奶，按需哺乳。产后15分钟～2小时内开奶，既可促进母乳分泌又可防止新生儿低血糖发生，还可减轻生理性体重下降及新生儿生理性黄疸。掌握“婴儿喂养方法”知识点。